目前，关于人类胚胎干细胞研究和应用中道德争议的焦点问题是
A. 人类胚胎干细胞的功能到底如何
B. 人类胚胎是否是生命、是否应该得到尊重
C. 人类胚胎发育阶段如何划分
D. 人类胚胎干细胞是否可以商品化
E. 人类胚胎是否可以克隆

正确答案：B。人类胚胎是否是生命、是否应该得到尊重